正常人每日随尿排出尿胆素原为
A. 0.4～3.5mg
B. 0.5～4.0mg
C. 0.6～5.5mg
D. 0.7～5.5mg
E. 0.8～5.5mg

正确答案：B。0.5～4.0mg

解析：肠道中生成的胆素原有10%～20%可被肠黏膜细胞重吸收，经门静脉入肝，其中大部分再次随胆汁排入肠腔，形成胆素原的肠肝循环。只有小部分胆素原进入体循环并入肾随尿排出，称为尿胆素原。正常人每日随尿排出尿胆素原0.5～4.0mg。尿胆素原被空气氧化后生成尿胆素，成为尿的主要色素。掌握“胆色素代谢”知识点。